男性，38岁。全口牙出血、咀嚼无力。且刚完成彻底的牙周系统治疗。无明显的系统性疾病。口腔检查：牙周袋深度较治疗前增加，X线片示：牙槽骨吸收有明显发展。口腔卫生情况良好。初步诊断为
A. 青少年牙周炎
B. 与糖尿病有关的牙周炎
C. 成人牙周炎
D. 快速进展性牙周炎
E. 顽固性牙周炎

正确答案：E。顽固性牙周炎

解析：本题考查顽固性牙周炎。顽固性牙周炎是指有些牙周炎患者对常规牙周治疗包括洁治、龈下刮治、牙周手术和抗生素治疗反应很差，或在经过彻底治疗后的短期内疾病继续加重而原因不明，而该患者经彻底的牙周系统治疗后，在无明显原因的情况下病变继续发展，牙周袋深度增加，牙槽骨吸收明显发展，符合顽固性牙周炎（E对）的病变特点。青少年牙周炎（A错）是指发生在青少年时期的一种特殊类型的牙周炎，病情发展较快，局部因素主要为特异性细菌的感染，全身因素主要是机体防御能力的缺陷，该患者处中年期，非青少年时期，故不属于青少年牙周炎。与糖尿病有关的牙周炎（B错）表现为牙周组织的炎症较重，龈缘红肿呈肉芽状增生，易出血和发生牙周脓肿，牙槽骨破坏迅速，导致深牙周袋和牙松动。成人牙周炎（C错）主要是由局部因素引起的牙周支持组织的慢性炎症，发病年龄以35岁以后较为多见，经牙周系统治疗后病变可恢复正常。快速进展性牙周炎（D错）是指在连续一段时间内病情进展迅速，破坏严重，疗效欠佳，发生于青春期到35岁之间的牙周炎，通常以年龄35岁以下和全口大多数牙的重度牙周破坏作为诊断标准。